慢性肾功能不全继发性甲状旁腺功能亢进最主要的原因是
A. 血肌酐增高
B. 血钾升高
C. 血磷升高
D. 维生素D减少
E. 酸中毒

正确答案：C。血磷升高

解析：慢性肾功能不全，肾小球滤过率下降，尿磷排泄减少，血磷升高（C对）。高血磷与血钙结合成磷酸钙沉积于软组织，导致软组织异位钙化，并使血钙降低。高磷血症与低钙血症可以刺激甲状旁腺分泌大量甲状旁腺素（甲状旁腺素主要用来调节钙磷代谢，使血钙升高、血磷降低），引起继发性甲状旁腺功能亢进。慢性肾功能不全可以出现血钾升高（B错）、维生素D减少（D错）、酸中毒（E错），主要与低钙血症形成有关，进一步引发甲状旁腺功能亢进，均不是最主要的原因。慢性肾功能不全也可形成血肌酐增高（A错），但其与继发性甲状旁腺功能亢进无关。